慢性痢疾属湿热积滞者，宜选用
A. 保和丸
B. 乌梅丸
C. 香连丸
D. 枳实导滞丸
E. 健脾丸

正确答案：C。香连丸

解析：香连丸中黄连，吴茱萸意在清热燥湿，木香以行气止痛。功效是清热燥湿，行气化滞。主治湿热痢疾（C对）。保和丸主治食滞胃脘证（A错）。乌梅丸主治脏寒蛔厥证（B错）。枳实导滞丸主治湿热食积证（D错）。健脾丸主治脾胃食积证（E错）。